在脂-水交界处定向排布，易于通过生物膜的基团是
A. 烃基
B. 卤素
C. 醚
D. 酰胺基
E. 羟基

正确答案：C。醚

解析：本题考查药物官能团。醚（C对）类化合物含有烷氧基键，其结构中的氧原子有孤对电子，能吸引质子，具有亲水性，烷烃基具有亲脂性，使醚类化合物在脂-水交界处定向排布，易于通过生物膜。